若全身作用栓剂中的药物为脂溶性，宜选基质为
A. 可可豆脂
B. 椰油酯
C. 硬脂酸丙二醇酯
D. 棕榈酸酯
E. 聚乙二醇

正确答案：E。聚乙二醇